可作为难溶性药物固体分散剂载体材料，达到速释效果的辅料是
A. 明胶
B. 乙基-β-CYD
C. PEG类
D. HPMC
E. 羟丙基-β-CYD

正确答案：C。PEG类

解析：本题考查固体分散体的载体材料。聚乙二醇（PEG）（C对）是固体分散体常用的的水溶性载体材料，在水中有比较好的溶解性和良好的药物相容性，可作为固体分散剂的载体，以达到速释效果。明胶（A错）可作为微囊的载体材料。乙基-β-CYD（B错）可作为水溶性药物的包合材料。HPMC（D错）（羟甲基纤维素）可作为薄膜包衣材料。羟丙基-β-CYD（E错）为水溶性环糊精衍生物，包合后可提高难溶性药物的溶解度，促进药物的吸收。